七号筛对应
A. 10
B. 24
C. 80
D. 120
E. 200

正确答案：D。120

解析：本题考查药筛的种类与规格。七号筛对应120（D对）。七号筛对应120筛目。一号筛对应10（A错）筛目。二号筛对应24（B错）筛目。五号筛对应80（C错）筛目。九号筛对应200（E错）筛目。